以下哪种情况中，患者应暂缓拔牙
A. 慢性肾衰竭如处于肾功能代偿期，临床无症状
B. 糖尿病患者空腹血糖为7.9mmol/L，无酸中毒
C. 妊娠期第5、6个月
D. 患者正处于月经期
E. 6个月内未发生过心肌梗死

正确答案：D。患者正处于月经期

解析：本题考查系统疾病对牙拔除术的影响及拔牙禁忌证。患者正处于月经期（D对）应暂缓拔牙。月经期拔牙，有可能发生代偿性出血，一般认为应暂缓拔牙。但必要时，简单的拔牙仍可进行，但要注意防止出血。慢性肾衰竭如处于肾功能代偿期，临床无症状（A错）；糖尿病患者空腹血糖为7.9mmol/L，无酸中毒（B错）；妊娠期第5、6个月（C错）；6个月内未发生过心肌梗死（E错）均可进行拔牙。